下列除哪项外，均是防风通圣散主治病证的临床表现
A. 憎寒壮热
B. 头目眩晕
C. 目赤睛痛
D. 大便秘结
E. 郁郁微烦

正确答案：E。郁郁微烦

解析：本题考查防风通圣散主治病症的了临床表现，属理解记忆内容。防风通圣散为表里双解剂，具有解表攻里，发汗达表，疏风退热之功效。主治表里俱实证。病证的临床表现憎寒壮热（A错），头目昏眩（B错），目赤睛痛（C错），口苦口干，咽喉不利，胸膈痞闷，咳呕喘满，涕唾黏稠，大便秘结（D错），小便赤涩。郁郁微烦不是防风通圣散主治病证的临床表现（E对）。趣记：小华说：江姐当住大石桥，借河山勤防马熊——硝滑芍：姜桔当术大石翘，芥荷山(栀)芩防麻芎。